按照甲类传染病管理的乙类传染病是
A. 猩红热
B. 艾滋病
C. 登革热
D. 流行性出血热
E. 肺炭疽

正确答案：E。肺炭疽

解析：为乙类传染病而按照甲类传染病管理的一类传染病有肺炭疽（E对），此外还包括传染性非典型肺炎和脊髓灰质炎。猩红热（A错）、艾滋病（B错）、登革热（C错）、流行性出血热（D错）均为乙类传染病，但并非按照甲类传染病管理。